生化汤的功用是
A. 温经散寒，祛瘀养血
B. 活血化瘀，温经止痛
C. 化瘀生新，行气止痛
D. 温中健脾，行气止痛
E. 活血化瘀，缓消癥块

正确答案：B。活血化瘀，温经止痛

解析：本题考查生化汤的功用。生化汤为理血剂，具有养血祛瘀，温经止痛之功效。主治血虚寒凝，瘀血阻滞证。产后恶露不行，小腹冷痛（B对）。记忆：生化汤宜产后服，归芎桃草酒炮姜。